成人肺结核最常见类型
A. 原发综合征
B. 血行播散型肺结核
C. 浸润性肺结核
D. 慢性纤维空洞型肺结核
E. 结核性胸膜炎

正确答案：C。浸润性肺结核

解析：成人肺结核多为继发型，血行播散型肺结核（B错）、浸润性肺结核、慢性纤维空洞型肺结核（D错）、结核性胸膜炎（E错）均属于继发型肺结核。继发型肺结核中，浸润性肺结核（C对）临床上最常见。原发综合征（A错）好发于儿童。